男，60岁，因“口内多数牙缺失，要求修复”来就诊，患者端坐在治疗椅上，在检查中发现患者口腔在不说话、不咀嚼、不吞咽时，上下颌牙列脱离接触，此时患者下颌所处的位置是
A. 下颌姿势位
B. 肌位
C. 牙尖交错位
D. 下颌后退接触位
E. 下颌前伸位

正确答案：A。下颌姿势位

解析：曾称为息止颌位。当头直立位，口腔在不咀嚼、不吞咽、不说话的时候，下颌处于休息状态，上下颌牙弓自然分开，从后向前保持着一个楔形间隙，称为息止（牙合）间隙，也称为自由间隙，约为1～3mm。此时下颌所处的位置，称为下颌姿势位。掌握“下颌姿势位、三类颌位与前伸、侧方（牙合）颌位”知识点。